下列说法中正确的有
A. 剂量指的是被摄入到体的量
B. 送达剂量是指应用剂量中被器官吸收的剂量
C. 生物有效剂量是指直接与机体的吸收屏障接触可供吸收的量
D. 化学物对机体的损害作用的性质和强度直接取决于其在靶器官中的剂量

正确答案：D。化学物对机体的损害作用的性质和强度直接取决于其在靶器官中的剂量

解析：本题考查剂量的相关内容。剂量主要指外源化学物与机体接触或被机体吸收或直接导致机体损害的量（A错）。生物有效剂量又称靶剂量，是指被吸收且到达毒作用器官组织产生毒作用的剂量（C错）。化学物对机体的损害作用的性质和强度，除了与该化学物毒性密切相关外，直接取决于其在靶器官中的剂量（D对B错）。